食用新鲜蚕豆发生溶血性黄疸患者缺陷的酶是
A. 3-磷酸甘油醛脱氢酶
B. 异柠檬酸脱氢酶
C. 琥珀酸脱氢酶
D. 6-磷酸葡萄糖脱氢酶
E. 6-磷酸葡萄糖酸脱氢酶

正确答案：D。6-磷酸葡萄糖脱氢酶

解析：食用新鲜蚕豆发生溶血性黄疸患者缺陷的酶是6-磷酸葡萄糖脱氢酶（D对）。6-磷酸葡萄糖脱氢酶是人体内磷酸戊糖途径的关键酶，其缺乏会导致患者不能通过磷酸戊糖途径提供足够的NADPH，难以使谷胱甘肽保持还原状态，因而表现出红细胞（尤其是较老的红细胞）易于破裂，发生溶血性黄疸。这种溶血现象常在食用蚕豆（是强氧化剂）后出现，故称为蚕豆病。3-磷酸甘油醛脱氢酶（P113）（A错）是在糖酵解阶段催化3-磷酸甘油醛为1，3-二磷酸甘油酸。异柠檬酸脱氢酶（P120）（B错）是柠檬酸循环中催化异柠檬酸氧化脱羧转变为ɑ-酮戊二酸的关键酶。琥珀酸脱氢酶（P121）（C错）是柠檬酸循环中催化琥珀酸脱氢生成延胡索酸的酶。6-磷酸葡萄糖酸脱氢酶（P127）（E错）是高等植物中磷酸戊糖途径中的关键酶之一。